当预警系统紧急启动后，地方各级人民政府及有关单位，针对突发环境污染事件采取的所有应对措施称之为
A. 应急预案
B. 预警系统
C. 应急响应
D. 应急保障
E. 应急准备

正确答案：C。应急响应

解析：本题考查应急响应。当预警系统紧急启动后，地方各级人民政府及有关单位，针对突发环境污染事件采取的所有应对措施称之为应急响应（C对ABDE错）。具体内容包括信息上报、应急监测、医疗救助、紧急疏散、应急处置和应急保障等。